属于含特殊药品复方制剂的是
A. 复方枇杷喷托维林颗粒
B. 氯胺酮注射液
C. 复方樟脑酊
D. 氨酚氢酮片

正确答案：A。复方枇杷喷托维林颗粒

解析：本题考查部分含特殊药品复方制剂的品种范围。属于含特殊药品复方制剂的是复方枇杷喷托维林颗粒（A对）。部分含特殊药品复方制剂的品种范围：1.口服固体制剂：每剂量单位：含可待因≤15mg的复方制剂；含双氢可待因≤10mg的复方制剂；含羟考酮≤5mg的复方制剂。具体品种如下：（1）阿司待因片；（2）阿司可咖胶囊；（3）阿司匹林可待因片；（4）氨酚待因片；（5）氨酚待因片（Ⅱ）；（6）氨酚双氢可待因片；（7）复方磷酸可待因片；（8）可待因桔梗片；（9）氯酚待因片；（10）洛芬待因缓释片；（11）洛芬待因片；（12）萘普待因片；（13）愈创罂粟待因片。2.含可待因复方口服液体制剂（列入第二类精神药品管理）：（1）复方磷酸可待因溶液；（2）复方磷酸可待因溶液（Ⅱ）；（3）复方磷酸可待因口服溶液；（4）复方磷酸可待因口服溶液（Ⅲ）；（5）复方磷酸可待因糖浆；（6）可愈糖浆；（7）愈酚待因口服溶液；（8）愈酚伪麻待因口服溶液。3.复方地芬诺酯片。4.复方甘草片、复方甘草口服溶液。5.含麻黄碱类复方制剂。6.其他含麻醉药品口服复方制剂：（1）复方福尔可定口服溶液；（2）复方福尔可定糖浆；（3）复方枇杷喷托维林颗粒；（4）尿通卡克乃其片。7.含曲马多口服复方制剂：（1）复方曲马多片；（2）氨酚曲马多片；（3）氨酚曲马多胶囊。精神药品目录：《精神药品品种目录（2013年版）》共有149个品种，其中第一类精神药品有68个品种，第二类精神药品有81个品种。目前，目录确定的我国生产及使用的第一类精神药品有7个品种，具体有以下品种。1.哌醋甲酯；2.司可巴比妥；3.丁丙诺啡；4.γ-羟丁酸；5.氯胺酮（B错）；6.马吲哚；7.三唑仑。目前，目录确定的我国生产及使用的第二类精神药品有28个品种，具体有以下品种。1.异戊巴比妥；2.格鲁米特；3.喷他佐辛；4.戊巴比妥；5.阿普唑仑；6.巴比妥；7.氯硝西泮；8.地西泮；9.艾司唑仑；10.氟西泮；11.劳拉西泮；12.甲丙氨酯；13.咪达唑仑；14.硝西泮；15.奥沙西泮；16.匹莫林；17.苯巴比妥；18.唑吡坦；19.丁丙诺啡透皮贴剂；20.布托啡诺及其注射剂；21.咖啡因；22.安钠咖；23.地佐辛及其注射剂；24.麦角胺咖啡因片；25.氨酚氢可酮片（D错）；26.曲马多；27.扎来普隆；28.佐匹克隆。需要说明的有两点，一是上述品种包括其可能存在的盐和单方制剂（除非另有规定）；二是上述品种包括其可能存在的化学异构体及酯、醚（除非另有规定）。麻醉药品目录：《麻醉药品品种目录（2013版）》共121个品种，其中我国生产及使用的品种及包括的制剂、提取物、提取物粉共有27个品种，具体有以下品种。1.可卡因；2.罂粟浓缩物（包括罂粟果提取物、罂粟果提取物粉）；3.二氢埃托啡；4.地芬诺酯；5.芬太尼；6.氢可酮；7.氢吗啡酮；8.美沙酮；9.吗啡（包括吗啡阿托品注射液）；10.阿片（包括复方樟脑酊（C错）、阿桔片）；11.羟考酮；12.哌替啶；13.瑞芬太尼；14.舒芬太尼；15.蒂巴因；16.可待因；17.右丙氧芬；18.双氢可待因；19.乙基吗啡；20.福尔可定；21.布桂嗪；22.罂粟壳。需要说明的有两点，一是上述品种包括其可能存在的盐和单方制剂（除非另有规定）；二是上述品种包括其可能存在的化学异构体及酯、醚（除非另有规定）。《条例》规定，麻醉药品目录中的罂粟壳只能用于中药饮片和中成药的生产以及医疗配方使用。